患者黄疸日久，黄色晦暗如烟熏，纳少脘闷，大便溏，神疲畏寒，口淡不渴，舌淡苔腻，脉沉迟。治疗应首选
A. 茵陈蒿汤
B. 甘露消毒丹
C. 茵陈术附汤
D. 黄连温胆汤
E. 茵陈四苓散

正确答案：C。茵陈术附汤

解析：患者黄疸日久可诊断为黄疸。中阳不振，寒湿滞留，肝胆失于疏泄，影响胆汁排泄，身目发黄而晦暗；寒湿困中，运化失健姑纳少脘闷，大便溏；寒湿损伤中阳，气血不足，故神疲畏寒。故可诊断为寒湿阻遏证，治宜温中化湿，健脾和胃，代表方茵陈术附汤（C对）。阳黄热重于湿证代表方茵陈蒿汤（A错）。甘露消毒丹利湿化浊，清热解毒，主治湿温时疫之湿热并重证（B错）。黄连温胆汤用于心悸痰火扰心证（D错）。茵陈四苓散用于治疗黄疸消退后湿热留恋（E错）。